个人防护用品的设计和制作原则不包括
A. 穿戴舒适
B. 经济耐用
C. 美观大方
D. 价格低廉
E. 对佩戴者不产生任何损害作用

正确答案：D。价格低廉